做桩冠修复，最好使用何种根充方法
A. 银尖+氢氧化钙糊剂
B. 氢氧化钙糊剂
C. 酚醛树脂
D. 牙胶尖+氢氧化钙糊剂
E. 碘仿糊剂

正确答案：D。牙胶尖+氢氧化钙糊剂

解析：本题考查桩冠修复的根充方法。桩核冠修复需要有严密的根尖封闭，以减少桩道根尖区引起根尖区感染，同时要求根充后能预备器械将根管中上端的材料去除，为桩道预留就位通道。牙胶尖+氢氧化钙符合上述要求，因此做桩冠修复时最好使用此方法（D对）。银尖有腐蚀性，腐蚀后释放的金属离子对根尖周组织有一定的刺激性，因此用银尖+氢氧化钙糊剂（A错）充填的根管不能用来进行桩冠修复。只用氢氧化钙糊剂（B错）或碘仿糊剂（E错）不用牙胶尖充填根管，根充不严密，细菌进入根管，易导致根尖炎症复发。酚醛树脂（C错）塑化后强度较大，桩道预备困难，且根管中被酚醛树脂包埋固定的病原刺激物易再次致病，因此用酚醛树脂充填的根管不能做桩冠修复。